下列药材宜用油炙的是
A. 黄连
B. 杜仲
C. 甘遂
D. 厚朴
E. 淫羊藿

正确答案：E。淫羊藿

解析：本题考查的是淫羊藿的炮制方法。下列药材宜用油炙的是淫羊藿（E对）。淫羊藿：【炮制方法】处方用名有淫羊藿、羊藿、仙灵脾、炙淫羊藿、炙羊藿。①淫羊藿：取原药材，除去杂质、枝梗，喷淋清水，稍润，切丝，干燥。②炙淫羊藿：取羊脂油置锅内加热熔化，加入淫羊藿丝，用文火加热，炒至油脂吸尽，表面呈油亮光泽时，取出，晾凉。每100kg淫羊藿，用羊脂油（炼油）20kg。黄连（A错）：【炮制方法】处方用名有黄连、川连、酒黄连、姜黄连、吴萸连、萸黄连。杜仲（B错）：【炮制方法】处方用名有杜仲、川杜仲、炒杜仲、盐杜仲。甘遂（C错）：【炮制方法】处方用名有甘遂、炙甘遂、醋甘遂。厚朴（D错）：【炮制方法】处方用名有厚朴、川厚朴、姜厚朴。